在我国哪型肝炎病后免疫力稳定且持续时间最长
A. HAV
B. HBV
C. HCV
D. HDV
E. HEV

正确答案：A。HAV

解析：本题考查病毒性肝炎的预后免疫。人体只要感染了HAV（A对BCDE错），无论是显性还是隐性感染，血清中HAV抗体滴度都将逐渐增高，并保持有牢固的免疫力。已具有免疫力者再度感染HAV可引起回忆应答，使已下降的抗体滴度再度升高，从而获得稳固而持久的保护性抗体，使免疫力维持时间更长，甚至终生。